治疗紫癜血热伤络证，应首选
A. 茜根散
B. 归脾汤
C. 泻心汤
D. 龙胆泻肝汤
E. 犀角地黄汤

正确答案：E。犀角地黄汤

解析：紫癜血热妄行证，治宜清热凉血，犀角地黄汤（E对）功效清热解毒，凉血散瘀，为首选。茜根散（A错）用于治疗阴虚火旺证。归脾汤（B错）可益气摄血，健脾养血，治疗气不摄血证。泻心汤（C错）治疗胃火炽盛证。龙胆泻肝汤（D错）治疗肝胆实火上炎证或肝胆湿热下注证。